下颌骨髁突内外径及前后径长度分别约为
A. 5～10mm和15～30mm
B. 5～10mm和8～10mm
C. 8～10mm和15～30mm
D. 15～30mm和15～30mm
E. 15～30mm和8～10mm

正确答案：E。15～30mm和8～10mm

解析：本题考查颞下颌关节的解剖特点。下颌骨髁突呈椭圆形，内外径长，约15～30mm，前后径短，约8～10mm（E对）。